胺碘酮偶致的不良反应是
A. 血尿酸和肌酐升高
B. 呼吸窘迫综合征
C. 肝坏死
D. 深静脉血栓形成
E. 骨质疏松症

正确答案：B。呼吸窘迫综合征

解析：本题考查胺碘酮的不良反应。胺碘酮的不良反应一般有心血管反应、甲状腺功能异常、视物模糊、便秘以及神经系统损伤等等。胺碘酮偶致严重的间质性肺炎或肺纤维，导致呼吸窘迫综合征（B对）。